个体处于应激状态时，表现出心率加快，血压增高，呼吸加速，血糖升高和肌张力增强，这些生理反应说明活动增强的神经内分泌系统是
A. 下丘脑-垂体-甲状腺轴
B. 下丘脑-垂体-肾上腺皮质轴
C. 交感-肾上腺髓质轴
D. 下丘脑-垂体-性腺轴
E. 下丘脑垂体后叶轴系

正确答案：B。下丘脑-垂体-肾上腺皮质轴

解析：应激是当机体遭受到各种有害刺激时，下丘脑-垂体-肾上腺皮质轴活动增强（B对）（交感-肾上腺髓质系统活动也增强，但不是主要作用），以ACTH和糖皮质激素（GC）分泌增多为主，多种激素共同参与的非特异性的防御性反应。交感肾上腺髓质系统（C错）能在机体遭遇到特殊紧急情况时发生的适应性反应，即应急反应，而非应激。